有关胸腺的描述，错误的是
A. 是人体重要的淋巴器官
B. 分左、右叶，但两叶多不一样大
C. 大部分位于前纵隔内
D. 上端有时可突入颈根部
E. 新生儿发达，成年后逐渐萎缩

正确答案：C。大部分位于前纵隔内

解析：胸腺是人体重要的中枢淋巴器官（A对）。胸腺分左、右叶，但两叶多不一样大（B对），呈扁条状。胸腺位于上纵隔前部（C错，为本题正确答案）。小儿胸腺上端可突入颈根部（D对）。幼儿和新生儿胸腺较大，性成熟后胸腺发育至最高峰，随后逐渐萎缩（E对）。